尿血红蛋白的呈阳性的原因
A. 创伤
B. 肾炎
C. 感染
D. 肿瘤
E. 服用他汀药物

正确答案：A、B、D、E。创伤；肾炎；肿瘤；服用他汀药物

解析：本题考查的是尿隐血的临床意义。尿血红蛋白的呈阳性的原因创伤（A对）、肾炎（B对）、肿瘤（D对）、服用他汀药物（E对）。尿中出现血红蛋白是血管内溶血的证据之一，因此尿血红蛋白测定有助于血管内溶血疾病的诊断。引起溶血的疾病有以下因素。1.红细胞破坏如心脏瓣膜手术、严重烧伤、剧烈运动、肌肉和血管组织严重损伤等。2.生物因素如疟疾感染、梭状芽孢杆菌中毒。3.动植物导致的溶血如蛇毒、蜂毒等。4.微血管性溶血性贫血如DIC。5.服用氧化剂药物如阿司匹林、磺胺、伯氨喹、硝基呋喃类、万古霉素等。